早期妊娠特有的表现
A. 停经
B. 早孕反应
C. 黑加征
D. 尿频
E. 蒙氏结节

正确答案：C。黑加征

解析：早期妊娠特有的表现是黑加征（C对），妊娠6-8周时，双合诊检查子宫峡部极软，感觉宫颈与宫体之间似不相连，停经（A错）并非早期妊娠特有的症状，需要与内分泌紊乱、哺乳期、服用避孕药或其他药物引起的停经相鉴别。早孕反应（B错）及尿频（D错）也并不是每个妊娠妇女都存在的症状，部分并不存这些症状，所以二者也不属于早期妊娠的特有表现。蒙氏结节（E错）是一直都存在的只是在孕前没有激素的刺激下不明显，所以该症状也不是早期妊娠所特有的。